一级反应半衰期计算公式是
A. 1gC=（-k/2.303）t+lgC₀
B. t₀.₉=C₀/10k
C. C-C₀=-kt
D. t₀.₉=0.1054/k
E. t1/2=0.693/k

正确答案：E。t1/2=0.693/k

解析：本题考查半衰期。t1/2=0.693/k （E对）为一级反应半衰期计算公式；lgC=（-k/2.303）t+lgC₀ （A错）为单室模型静脉注射给药后血药浓度与时间的关系；t₀.₉=C₀/10k（B错）为零级反应有效期计算公式；C-C₀=-kt（C错）为零级动力学计算公式的积分结果；t₀.₉=0.1054／k（D错）为中药制剂一级反应的有效期的计算公式。